《药品不良反应报告和监测管理办法》规定，药品生产企业、药品经营企业、医疗卫生机构应
A. 及时报告药品不良反应
B. 直接向国务院药品监督管理部门报告药品不良反应
C. 向省级药品监督管理局和卫生厅报告药品不良反应
D. 按规定报告所发现的药品不良反应
E. 按规定反映所在地发生的药品不良反应

正确答案：D。按规定报告所发现的药品不良反应

解析：本题考查药品不良反应报告和监测管理办法。《药品不良反应报告和监测管理办法》规定，药品生产企业、药品经营企业、医疗卫生机构应按规定报告所发现的药品不良反应（D对）。《药品不良反应报告和监测管理办法》第一章总则第三条：国家实行药品不良反应报告制度。药品生产企业（包括进口药品的境外制药厂商）、药品经营企业、医疗机构应当按照规定报告所发现的药品不良反应。